职业病的分类和目录由（）行政部门会同国务院安全生产监督管理部门、劳动保障行政部门制定、调整并公布
A. 公安
B. 卫生
C. 地方
D. 工会
E. 企业

正确答案：B。卫生